影响人群易感性升高的主要因素有
A. 有计划、有步骤地开展预防接种工作
B. 流行后免疫人口的增加
C. 隐性感染后免疫人口的增加
D. 新生儿在人群比例的增加
E. 免疫人口的迁入

正确答案：D。新生儿在人群比例的增加